暴露生物学标志物的检测注意事项不包括
A. 时间
B. 剂量
C. 技术
D. 途径

正确答案：B。剂量

解析：本题考查暴露生物学标志物的检测注意事项。暴露生物标志是指测定的组织、体液或排泄物中吸收的外源化学物、其代谢物或与内源性物质的反应产物的含量，且其可作为吸收剂量或靶剂量，可提供关于暴露于外源化学物的信息的指标，常用以反映机体生物材料中外源性化学物或其代谢物或外源性化学物与某些靶细胞或靶分子相互作用产物的含量。暴露生物学标志物的检测注意事项包括时间（A对）、技术（C对）、途径（D对）等，不包括剂量（B错，为本题正确答案）。